男，22岁，右腹部胀痛伴血尿3月余，KUB+IVU诊断右肾盂结石，大小1.8cm×1.2cm，右肾轻度积水，肾功能正常，首选的治疗方法是
A. 药物排石
B. 体外冲击波碎石（ESWL）
C. 右肾盂切开取石术
D. 经皮肾镜激光碎石
E. 抗感染治疗

正确答案：B。体外冲击波碎石（ESWL）

解析：患者反复右腰部绞痛伴血尿。KUB见右肾结石，长径1.8cm≦2cm，首选的治疗方法为体外冲击波碎石（B对）。药物排石（A错）主要用于结石﹤0.6cm、结石表面光滑、结石以下尿路无梗阻的患者。肾盂切开取石（C错）适用于肾盂输尿管处梗阻合并肾盂结石，可在取石的同时解除梗阻。经皮肾镜激光碎石（D错）适用于所有需开放手术干预的肾结石，如≥2cm的肾结石和体外冲击波难以粉碎的结石。抗感染治疗（E错）只能缓解肾绞痛，不能根治，不作为首选的治疗方法。